引起副溶血性弧菌的主要食物是
A. 谷类
B. 豆类
C. 肉类
D. 海产品
E. 奶类

正确答案：D。海产品